位于上腹部脐中上4寸，前正中线上的腧穴是
A. 中脘
B. 中极
C. 关元
D. 气海
E. 膻中

正确答案：A。中脘

解析：中脘定位在上腹部，脐中上4寸，前正中线上（A对）。中极定位在下腹部，脐中下4寸，前正中线上（B错）。关元定位在下腹部，脐中下3寸，前正中线上（C错）。气海定位在下腹部，脐中下1.5寸，前正中线上（D错）。膻中定位在胸部，横平第4肋间隙，前正中线上（E错）。